手足厥寒，舌淡苔白，脉沉细者，治疗应选用
A. 四逆汤
B. 当归四逆汤
C. 回阳救急汤
D. 右归丸
E. 大建中汤

正确答案：B。当归四逆汤

解析：本题考查常见的病症的辩证、处方。题中手足厥寒，舌淡苔白，脉沉细者，证属血虚寒厥证。四逆汤为温里剂，主治心肾阳衰寒厥证。四肢厥逆，恶寒蜷卧，神衰欲寐，面色苍白腹痛下利，呕吐不渴，舌苔白滑，脉微细（A错）。当归四逆汤为温里剂，具有温经散寒，养血通脉之功效。主治血虚寒厥证。手足厥寒，或腰、股、腿、足、肩臂疼痛，口不渴，舌淡苔白，脉沉细或细而欲绝（B对）。回阳救急汤为温里剂，具有回阳固脱，益气生脉之功效。主治寒邪直中三阴，真阳衰微证。四肢厥冷，神衰欲寐，恶寒蜷卧，吐泻腹痛，口不渴，甚则身寒战栗，或指甲口唇青紫，或吐涎沫，舌淡苔白，脉沉微，甚或无脉。临床常用于急性胃肠炎吐泻过多、休克、心力衰竭等属亡阳欲脱者（C错）。右归丸为补益剂，具有温补肾阳，填精止遗之功效。用于肾阳不足，命门水衰，腰膝酸冷，精神不振，怯寒畏冷，阳痿遗精，大便溏薄，尿频而清（D错）。大建中汤为温里剂，具有温中补虚，降逆止痛之功效。主治中阳衰弱，阴寒内盛之脘腹剧痛证。心胸中大寒痛，呕不能食，腹中寒，上冲皮起，出见有头足，上下痛而不可触近，手足厥冷，舌质淡，苔白滑，脉沉伏而迟（E错）。